还有
A. 止血
B. 解毒
C. 养阴
D. 利尿
E. 化瘀

正确答案：C。养阴

解析：生地黄和玄参均为清热凉血药，两者均有清热凉血，养阴生津之功，但玄参具有泻火解毒的功效，常用于咽喉肿痛、痰火瘰疬等（C对）。